男性，63岁。上腹痛2小时，伴恶心，呕吐胃内容物2次，在下列疾病诊断中，可能性最小的是
A. 心肌梗塞
B. 急性胰腺炎
C. 急性阑尾炎
D. 美尼尔综合征
E. 急性胃炎

正确答案：D。美尼尔综合征

解析：梅尼埃尔综合征（D错，为本题正确答案）即梅尼埃病，一种特发性内耳疾病。可表现为恶心、呕吐，但发病年龄多在50岁以下，且每次发作持续时间多超过24小时，多表现为发作性眩晕、伴有耳鸣、耳阻塞感，反复发作后听力减退等症状。不典型的心肌梗死（A对）患者可表现为上腹部疼痛，疼痛剧烈时常伴有频繁的恶心、呕吐和上腹胀痛。急性胰腺炎（B对）主要表现为饱餐或饮酒后突发上腹部持续剧烈疼痛，伴恶心、呕吐，且呕吐后疼痛不缓解。急性阑尾炎（C对）常表现为起始上腹部疼痛，逐渐移向脐部，呈典型的转移性右下腹痛，可伴有恶心、呕吐，但程度较轻。急性胃炎（E对）常表现为上腹痛、恶心、呕吐。